通过观察或实验获得的健康人群某种营养素的摄入量系指
A. 估计平均需求量
B. 推荐摄入量
C. 适宜摄入量
D. 可耐受最高摄入量
E. 生理需要量

正确答案：C。适宜摄入量